男，38岁。由于腹部剧痛服用大量镇痛药，家属发现时该患者昏迷，呼吸困难，查体见瞳孔缩小。治疗首选的药物为
A. 喷他佐辛
B. 罗通定
C. 曲马多
D. 芬太尼
E. 纳洛酮

正确答案：E。纳洛酮

解析：男，38岁。由于腹部剧痛服用大量镇痛药，家属发现时该患者昏迷，呼吸困难，查体见瞳孔缩小（阿片类中毒“三联征”：昏迷、呼吸抑制、瞳孔缩小），考虑为阿片类药物急性中毒，治疗首选纳洛酮（E对），为阿片受体竞争性拮抗药，对各型阿片受体均有竞争性拮抗作用，可迅速改善呼吸，使意识清醒。